女，48岁，某乡镇企业负责人。5个月前被确诊为乳腺癌并接受了手术治疗。术后患者仅休息了2个月，便全身心投入了工作，同病前一样从事日常工作，参加各种会议和活动。对于自己身体的康复情况并不重视，不按要求到医院复查，也不愿再接受任何其他的治疗。该女性角色行为改变类型属于
A. 角色行为冲突
B. 角色行为缺如
C. 角色行为异常
D. 角色行为减退
E. 角色行为强化

正确答案：D。角色行为减退

解析：病人角色适应不良（C错）是指病人不能顺利地完成角色转变的过程。常见的角色适应不良有角色行为缺如、角色行为冲突、角色行为减退、角色行为强化、角色行为异常。角色行为冲突（A错）是指当多种社会地位和多种角色集于一人时，在其自身内部产生的冲突。角色行为缺如（B错）是指病人未能进入病人角色，不承认自己是病人。角色行为减退（D对）失指个体进入病人角色后，由于某种原因又重新承担起本应免除的社会角色的责任，放弃了病人角色去承担其他角色的活动。题中病人仅休息两个月就走出病人角色去承担其正常时角色的责任和义务，是典型的角色行为减退。角色行为强化（E错）是指个体“安于”病人角色的现状，角色的行为与其躯体症状不相吻合，过分地对自我能力表示怀疑、失望和忧虑，行为上表现出较强的退缩和依赖性。